成釉细胞瘤的穿刺液常为
A. 淡黄色
B. 不凝的血性液体
C. 清亮的黏液
D. 褐色液体
E. 草绿色液体

正确答案：D。褐色液体

解析：本题考查成釉细胞瘤的穿刺液。成釉细胞瘤为颌骨中心性上皮肿瘤，在牙源性肿瘤中较为常见，多发生于成年人，由于肿瘤含有大小不等的囊腔，穿刺检查可抽出褐色液体（D对）。淡黄色（A错）穿刺液多见于颌骨囊肿。不凝的褐色血样液体（B错）多见于神经鞘瘤穿刺液体。清亮的黏液（C错）多见于鳃裂囊肿穿刺液体。草绿色液体（E错）多见于牙源性颌骨囊肿穿刺液体，如根端囊肿、始基囊肿及含牙囊肿。